对脾大与腹腔肿块的鉴别，最有意义的是
A. 质地
B. 活动度
C. 有无压痛
D. 有无切迹
E. 叩诊音的差异

正确答案：D。有无切迹

解析：对脾大与腹腔肿块的鉴别，最有意义的是有无切迹（D对），脾的上缘前部有2～3个切迹，称脾切迹，脾肿大时，脾切迹仍存在，可作为触诊脾的标志。而质地（A错）、活动度（B错）、有无压痛（C错）、叩诊音的差异（E错）在脾大和腹腔肿块时均相似，故不能作为脾肿大的鉴别诊断。